男，52岁，烧伤病人，烧伤总面积35％，其中Ⅲ°烧伤面积10％。该患者属于烧伤的类型是
A. 轻度烧伤
B. 中度烧伤
C. 重度烧伤
D. 特重烧伤
E. 小面积烧伤

正确答案：C。重度烧伤

解析：烧伤严重程度分度：①轻度烧伤：Ⅱ°烧伤面积10%以下（A错）；②中度烧伤：Ⅱ°烧伤面积11%～30%，或有Ⅲ°烧伤但面积不足10%（B错）；③重度烧伤：烧伤总面积31%～50%；或Ⅲ°烧伤面积11%～20%；或Ⅱ°、Ⅲ°烧伤面积虽不到上述百分比，但已发生休克等并发症，或存在较重的吸入性损伤、复合伤等（C对）；④特重烧伤：烧伤总面积50%以上；或Ⅲ°烧伤20%以上（D错）。八版外科学未明确定义小面积烧伤（E错）。